与Ⅰ型超敏反应发生无关的细胞
A. 嗜酸性粒细胞
B. 嗜中性粒细胞
C. B细胞
D. 嗜碱性粒细胞
E. CD4+Th2细胞

正确答案：B。嗜中性粒细胞

解析：本题考查与Ⅰ型超敏反应发生有关的细胞。嗜中性粒细胞（B错，为本题的正确答案）主要参与机体的炎症反应，并不参与Ⅰ型超敏反应。Ⅰ型超敏反应，又称变态反应或速发型超敏反应是由IgE介导，肥大细胞和嗜碱性粒细胞（D对）释放生物活性介质引起的局部或全身反应；变应原刺激的Th2型反应可产生大量IL-4等细胞因子，诱导特异性B细胞（C对）向IgE类别转换并增殖、分化成产生IgE的CD4+Th2细胞（E对）；另外，嗜酸性粒细胞（A对）还能释放组胺酶和芳基硫酸酯酶，灭活肥大细胞释放的组胺和LT，对I型超敏反应起到一定的抑制作用。